实验动物切除胸腺后（新生期）机体淋巴结
A. 浅皮质缺乏T细胞
B. 深皮质缺乏T细胞
C. 髓索缺乏T细胞
D. 生发中心缺乏T细胞
E. 深皮质区无明显变化

正确答案：B。深皮质缺乏T细胞